一个咀嚼周期内牙齿接触的时间平均为
A. 0.1s
B. 0.15s
C. 0.2s
D. 0.25s
E. 0.3s

正确答案：C。0.2s

解析：本题考查咀嚼周期。一个咀嚼周期内牙齿接触的时间平均为0.2s（C对）。一个咀嚼周期所需时间平均为0.875秒，牙齿接触的时间平均为0.2秒。一般的咀嚼速度是70～80次/min。一个咀嚼周期正常轨迹图形和运动时间分配的特征有：（1）轨迹图具有似滴泪水的形态，开口相靠中线，闭口相偏侧方。（2）自牙尖交错位开口时相，运动速度较快。（3）近最大开口位时运动速度缓慢，但闭口运动始，速度又加快。（4）闭口运动将近咬合接触时，运动速度缓慢，近牙尖交错（牙合）时运动速度急速减缓趋于静止不动，产生力的效应。咀嚼运动的速度在整个开口和闭口运动之间，左侧方和右侧方运动之间，大体上差别不大。